对急性坏死型肝炎评价临床抢救效果时最恰当的指标应是
A. 死亡率
B. 发病率
C. 患病率
D. 病死率
E. 罹患率

正确答案：D。病死率